女性，60岁。口腔干燥、无泪、双眼异物感1年余。两侧腮腺区有反复肿胀史。检查发现：唇黏膜发红，舌表面光滑潮红呈“镜面舌”。口内大多数牙有龋坏，两侧腮腺弥漫性肿大，无压痛。挤压腺体导管口唾液溢出很少。腮腺造影示：主导管扩张不等，边缘毛糙，呈葱皮样或花边样改变，末梢导管呈点状、球状扩张。血沉加快，γ球蛋白增高，泪液分泌减少，结合临床最可能的诊断是
A. 急性化脓性腮腺炎
B. 流行性腮腺炎
C. 慢性阻塞性腮腺炎
D. 慢性复发性腮腺炎
E. 舍格伦综合征继发感染

正确答案：E。舍格伦综合征继发感染

解析：本题考查舍格伦综合征。腮腺造影结果表明腮腺排空功能减退，血沉加快病理情况下见于各种炎征，再联系该患者的主诉以及现病史，可知该患者最可能的诊断是舍格伦综合征继发感染（E对）。急性化脓性腮腺炎（A错）表现为腮腺区疼痛、肿胀、压痛，可见导管口明显红肿，轻轻按摩腺体可见脓液自导管口溢出，常伴有全身征状，而该患者腮腺区无压痛，挤压腺体无脓液溢出。流行性腮腺炎（B错）多见于儿童，有传染接触史，腮腺区肿大、充血、压痛，该患者为老年女性，腮腺区仅表现为肿大而无压痛。慢性阻塞性腮腺炎（C错）多是由导管口狭窄或异物阻塞导管所致，多数患者肿胀与进食有关，若挤压腺体可见导管口流出混浊的雪花样或粘稠的蛋清样液体，不符合患者的主诉和现病史。慢性复发性腮腺炎（D错）多见于儿童，腮腺造影显示末梢导管呈点状、球状扩张，排空迟缓，而主导管及腺内导管无明显异常，而该患者的腮腺造影显示为主导管扩张不等。